男，30岁，急性阑尾炎发病已4天，腹痛稍减轻，但仍有发热，右下腹可触及有压痛的肿块，应
A. 立即手术，切除阑尾
B. 立即手术，切除肿块
C. 立即手术，腹腔引流
D. 暂不手术，用广谱抗生素治疗
E. 用广谱抗生素治疗，不需手术

正确答案：D。暂不手术，用广谱抗生素治疗